溃疡性结肠炎的病变大多位于
A. 空肠
B. 末段回肠
C. 回盲部
D. 全结肠
E. 直肠、乙状结肠

正确答案：E。直肠、乙状结肠

解析：溃疡性结肠炎病变多自直肠开始，逆行向近段发展，可累及全结肠甚至末段回肠，以直肠、乙状结肠最常见（E对）。末段回肠（B错）是伤寒、克罗恩病（P377）的好发部位；回盲部（C错）是肠结核的好发部位（P368）。